社区是人际暴力产生的生态模式的
A. 第一层
B. 第二层
C. 第三层
D. 第四层
E. 第五层

正确答案：C。第三层

解析：本题考查社区于生态模式的地位。社区是生态模式的第三个层面（C对ABDE错），个体的大多数社会关系都发生在社区，其特征可能与个体成为施暴者或受害者有关。